胃食管反流的患者应避免使用的药物是
A. 阿司匹林
B. 阿仑膦酸钠
C. 特拉唑嗪
D. 美托洛尔
E. 多潘立酮

正确答案：B。阿仑膦酸钠

解析：本题考查胃食管反流病的禁用药。阿仑膦酸钠（B错，为本题正确答案）主要不良反应为食管炎，可加重胃反流症状，故胃食管反流的患者应避免使用。胃食管反流患者可以使用阿司匹林（A对）、特拉唑嗪（C对）、美托洛尔（D对）、多潘立酮（E对）。